3天前做完牙髓治疗，逐渐出现咬合痛，X线正常，没有超出根管。原因为
A. 遗漏根管
B. 超预备
C. 药物刺激
D. 残髓炎
E. 超填

正确答案：C。药物刺激

解析：本题考查根管治疗后疼痛的原因。3天前做完牙髓治疗，逐渐出现咬合痛，X线正常，没有超出根管。原因为药物刺激（C对）。当根尖屏障缺如或受到破坏时，根管治疗所用的各种冲洗剂也存在着溢出根尖孔的可能，此时可对根尖周组织造成化学刺激，化学刺激所造成的组织反应与所用消毒剂的细胞毒性密切相关。遗漏根管（A错）、超预备（B错）、残髓炎（D错）、超填（E错）与题干中的X线表现不符。